蚕豆病是红细胞葡萄糖-6-磷酸脱氢酶（G-6-PD）缺乏症患者进食蚕豆或蚕豆制品后诱发的一种急性血管内溶血，该患者最可能缺乏什么
A. NADPH
B. ATP
C. cAMP
D. NADP
E. FAD

正确答案：A。NADPH

解析：葡糖-6-磷酸脱氢酶缺陷者，其红细胞不能经磷酸戊糖途径获得充足的NADPH，不足以使谷胱甘肽保持还原状态，因而表现出红细胞（尤其是较老的红细胞）易于破裂，发生溶血性黄疸。